推荐剂量下常见中枢抑制、乏力等不良反应的是
A. 阿司匹林
B. 法莫替丁
C. 葡萄糖酸钙
D. 碱式硝酸铋复方制剂
E. 盐酸异丙嗪（非那根）

正确答案：E。盐酸异丙嗪（非那根）